患儿，男，2岁。行唇裂修复术时，需加用眶下神经阻滞麻醉，进针点是
A. 眶下缘中点下1.5cm，鼻翼至耳屏连线的中点
B. 眶下缘中点下0.5cm，鼻尖至耳屏连线的中点
C. 眶下缘中点下1.5cm，鼻翼至睑外侧连线的中点
D. 眶下缘中点下0.5cm，鼻尖至睑外侧连线的中点
E. 眶下缘中点下0.5cm， 鼻翼至睑外侧连线的中点

正确答案：E。眶下缘中点下0.5cm， 鼻翼至睑外侧连线的中点

解析：本题考查眶下神经阻滞麻醉。患儿，男，2岁。行唇裂修复术时，需加用眶下神经阻滞麻醉，进针点是眶下缘中点下0.5cm，鼻翼至脸外侧连线的中点（E对）。眶下神经阻滞麻醉将局麻药注入眶下孔或眶下管，以麻醉眶下神经及其分支，又称眶下孔或眶下管注射法。（1）口外注射法：眶下孔位于眶下缘中点下方0.5～1cm处。注射时用左手示指扪出眶下缘，右手持注射器自同侧鼻翼旁约1cm处刺入皮肤。注射针与皮肤成45°角，向上后外进针约1.5cm，刺入眶下孔并注射麻药约1mL，3～5分钟后即可显现麻醉效果。（2）口内注射法：牵引上唇向前向上，注射针与上颌中线成45°角，于侧切牙根尖相应部位的口腔前庭沟刺入，向上后外进针，即可到达眶下孔，但不易进入眶下管。